《温热论》说：“在表初用辛凉轻剂”，挟风则加入
A. 银花豆豉之属
B. 荆芥防风之属
C. 薄荷牛蒡之属
D. 桑叶菊花之属
E. 薄荷蝉蜕之属

正确答案：C。薄荷牛蒡之属

解析：温邪从口鼻而入，初起多有肺卫分过程，邪热未传心包尚在肺卫，病仍在表。温邪在表，治宜辛凉宣透，轻清疏泄，用辛凉轻剂。切不可误用辛温发汗，助热伤津，而致生变。温邪每易兼夹风邪或湿邪为患，治疗夹风者，在辛凉轻剂中可加入薄荷、牛蒡等辛散之品（C对），使风从外解，热易清除。